将健康信息以最快、最通畅渠道传递给目标人群，要选择的传播媒介应是
A. 保证效果
B. 针对性
C. 经济性
D. 速度快
E. 可及性高

正确答案：D。速度快